唇裂病人上唇的解剖形态是
A. 上唇下1/3部微向上翘
B. 红唇中部稍厚且正中部呈珠状而向前下突出
C. 上下唇宽度比例和谐
D. 鼻小柱及鼻尖居中，鼻孔对称等大
E. 鼻小柱歪斜，鼻孔不对称

正确答案：E。鼻小柱歪斜，鼻孔不对称

解析：本题考查唇裂病人上唇的解剖形态。唇裂时，上唇的连续性发生中断，鼻小柱受两侧的口轮扎肌肌肉牵拉的作用出现歪斜、鼻孔不对称（E对）等改变。上唇下1/3部微向上翘（A错）；红唇中部稍厚且正中部呈珠状而向前下突出（B错）；上下唇宽度比例和谐（C错）；鼻小柱及鼻尖居中，鼻孔对称等大（D错），以上都是正常上唇的形态特点。